管理本行政区域内医师工作的机构是
A. 县级以上人民政府工商行政部门
B. 县级以上人民政府劳动人事部门
C. 各级人民政府
D. 县级以上人民政府卫生行政部门
E. 各级医师协会

正确答案：D。县级以上人民政府卫生行政部门

解析：本题考查医师执业注册。管理本行政区域内医师工作的机构是县级以上人民政府卫生行政部门（D对ABCE错）。《执业医师法》规定，国家实行医师执业注册制度。国务院卫生行政部门负责全国医师执业注册监督管理工作。县级以上地方卫生行政部门是医师执业注册的主管部门，负责本行政区域内的医师执业注册监督管理工作。中医（包括中医、民族医、中西医结合）医疗机构的医师执业注册管理由中医（药）主管部门负责。